可能引起牙龈增生的药物是
A. 甲氨蝶呤
B. 硫唑嘌呤
C. 羟氯喹
D. 柳氮磺吡啶
E. 环孢素

正确答案：E。环孢素

解析：本题考查环孢素。可能引起牙龈增生的药物是环孢素（E对）。环孢素用于重症RA，主要不良反应有高血压、肝肾毒性、神经系统损害、继发性感染、肿瘤以及胃肠道反应、齿龈增生、多毛等。甲氨蝶呤（A错）常见的不良反应有恶心、口炎、腹泻、脱发、皮疹，少数出现骨髓抑制、听力损害和肺间质病变，也可引起流产、畸胎和影响生育力。硫唑嘌呤（B错）可致骨髓抑制，肝功能损害，畸胎，亦可发生皮疹，偶见肌萎缩。羟氯喹（C错）的不良反应有厌食、恶心、呕吐、腹泻、腹部痉挛、肝功能异常等。柳氮磺吡啶（D错）的不良反应有肾炎、肾病综合征、尿路感染、血尿、晶体尿、蛋白尿等。